关于生长的正确概念是
A. 细胞和组织的分化
B. 细胞繁殖增大和细胞间质的增加
C. 细胞的繁殖与增大
D. 组织器官与身体各部大小重量的增加
E. 身体组织成分的变化

正确答案：B。细胞繁殖增大和细胞间质的增加

解析：本题考查生长的概念。生长指细胞体积的增大，大多数的组织器官都是通过不断的细胞分裂增殖来生长，随着个体的不断发育，神经元细胞特别是轴突的部分也要不断的增加（B对ACDE错）。